适用于大量腹水而肝、脾难以触及时的触诊方法是
A. 浅部触诊法
B. 深部滑行触诊法
C. 双手触诊法
D. 深压触诊法
E. 冲击触诊法

正确答案：E。冲击触诊法

解析：冲击触诊法（E对）又称浮沉触诊法，其操作为检查时，右手并拢的示、中、环三个手指取70°～90°角，放置于腹壁拟检查的相应部位，作数次急速而较有力的冲击动作，在冲击腹壁时指端会有腹腔脏器或包块浮沉的感觉，此法适用于大量腹水而肝、脾难以触及时的患者。浅部触诊法（A错）适用于体表浅在病变如关节、软组织、浅部动脉、静脉的检查与评估。深部滑行触诊法（B错）常用于腹腔深部包块和胃肠病变的检查。双手触诊法（C错）常用于肝、脾、肾和腹腔肿物的检查。深压触诊法（D错）用于探测腹腔深在病变的部位或确定腹腔压痛点，如阑尾压痛点、胆囊压痛点和输尿管压痛点。